既活血定痛，又泻下通便的药是
A. 干漆
B. 血竭
C. 苏木
D. 虎杖
E. 自然铜

正确答案：D。虎杖

解析：本题考查虎杖的功效。既活血定痛，又泻下通便的药是虎杖（D对）。虎杖【功效】利湿退黄，清热解毒，活血祛瘀，化痰止咳，泻下通便。干漆（A错）【功效】破血祛瘀，杀虫。血竭（B错）【功效】活血定痛，化瘀止血，生肌敛疮。苏木（C错）【功效】活血祛瘀，消肿止痛。自然铜（E错）【功效】散瘀止痛，接骨疗伤。